学校卫生标准规定，中小学生教学用房普通教室人均使用面积的要求是
A. 中学1.22m²；小学1.15m²
B. 中学1.15m²；小学1. 12m²
C. 中学1.20m²；小学1. 15m²
D. 中学1.25m²；小学1. 20m²
E. 中学1.35m²；小学1. 25m²

正确答案：A。中学1.22m²；小学1.15m²